下列哪项不是慢性涎腺炎的病理表现
A. 小叶腺泡萎缩
B. 小叶导管上皮增生
C. 小叶导管扩张
D. 小叶轮廓保留
E. 小叶间质淋巴细胞浸润

正确答案：D。小叶轮廓保留

解析：镜下见唾液腺导管扩张，导管内有炎症细胞；导管周围及纤维间质中有淋巴细胞和浆细胞浸润，或形成淋巴滤泡；腺泡萎缩、消失，被增生的纤维结缔组织取代；小叶内导管上皮增生，并可见鳞状化生。小叶轮廓保留是舍格伦综合征的病理变化。掌握“慢性唾液腺炎的病理变化”知识点。